计算平均潜伏期宜用
A. 算术平均数
B. 全距
C. 离均差积和
D. 中位数
E. 变异数

正确答案：D。中位数

解析：本题考查平均潜伏期的计算。平均潜伏期的计算，一般以中位数（D对ABCE错）更能代表其平均水平。